下列哪项是导致DIC发病的关键环节？
A. 凝血因子V的激活
B. 凝血因子Ⅻ的激活
C. 组织因子大量入血
D. 凝血酶原激活物的形成
E. 凝血酶生成增加

正确答案：E。凝血酶生成增加

解析：凝血酶生成增加（E对ABCD错）是导致DIC发病的关键环节。DIC是指在某些致病因子的作用下，大量促凝物质入血，凝血因子和血小板被激活，凝血酶生成增加，微循环中形成广泛的微血栓，继而因凝因子和血小板大量消耗，引起继发性纤维蛋白溶解功能增强，机体出现以止、凝血功能障碍为特征的病理生理过程。